男性，54岁。吸烟史30年，慢性支气管炎病史3年，咳嗽，咯痰，痰中带血1个月伴声音嘶哑。可考虑为
A. 慢性支气管炎急性发作
B. 支气管扩张
C. 支气管肺癌
D. 支气管哮喘
E. 肺炎

正确答案：C。支气管肺癌

解析：患者吸烟史30年，慢性支气管炎病史3年，咳嗽，咯痰，痰中带血1个月伴声音嘶哑，诊断为支气管肺癌（C对）。慢性支气管炎急性发作（A错）表现为咳嗽，咳白色粘液痰。支气管扩张（B错）的特点为咳腥臭脓痰。支气管哮喘（D错）发作有哮鸣音。肺炎（E错）有病原体感染史，咳嗽，胸痛。